女子的乳房，属
A. 心
B. 肾
C. 脾
D. 肝
E. 胃

正确答案：E。胃

解析：乳房与经络的关系密切，足阳明胃经行贯乳中，故女子乳房属胃（E对）（ABCD错）。